男性，30岁，1年前下岗。近5个月来觉得邻居都在议论他，常不怀好意地盯着他，有时对着窗外大骂，自语自笑，整天闭门不出，拨110电话要求保护。该病例最可能的诊断是
A. 反应性精神病
B. 躁狂抑郁症
C. 偏执性精神病
D. 分裂样精神病
E. 精神分裂症

正确答案：E。精神分裂症

解析：该病例患者中年男性，1年前下岗。近5个月来觉得邻居都在议论他，有时对着窗外大骂，自语自笑（幻觉），常不怀好意地盯着他（妄想），闭门不出（妄想、幻觉的支配下所表现的行为），故诊断为精神分裂症（E对）。反应性精神病是由于剧烈或持续的精神紧张性刺激直接引起，无强烈的精神因素刺激，与本例不符（A错）。与本例患者无躁狂抑郁症“三高”、“三低”的典型表现不符，故不考虑（B错）。偏执性精神病是一大组疾病的概称，具有偏执性妄想，其程度轻重不一，但无幻觉，与本例不符（C错）。